下列可防止微血管病变的药物是
A. 甲苯磺丁脲
B. 氯磺丙脲
C. 格列本脲
D. 格列吡嗪
E. 格列齐特

正确答案：E。格列齐特